下列实验室检查结果中，支持再生障碍性贫血的是
A. 外周血出现有核红细胞
B. 外周血淋巴细胞比例减低
C. 中性粒细胞碱性磷酸酶积分减低
D. 骨髓中巨核细胞减低
E. 骨髓中非造血细胞减低

正确答案：D。骨髓中巨核细胞减低

解析：再生障碍性贫血时，骨髓造血功能衰竭，主要表现为全血细胞减少。血象呈正常细胞性贫血，网织红细胞减低，红细胞、白细胞、血小板均减低，淋巴细胞比例增高（B错）；骨髓象多部位增生减低或重度减低，粒、红系及巨核细胞明显减少（D对），淋巴细胞及非造血细胞比例明显增高（E错），骨髓小粒空虚。外周血出现有核红细胞（P553）（A错）提示骨髓增生活跃，常见于溶血性贫血等疾病；中性粒细胞碱性磷酸酶主要存在于成熟阶段的中性粒细胞，中性粒细胞碱性磷酸酶积分减低（C错）常见于中性粒细胞发育障碍或异形增生，如急、慢性粒细胞白血病等，再生障碍性贫血时中性粒细胞碱性磷酸酶积分增高。